患者女性，35岁，转移性右下腹疼痛3天，右下腹压痛反跳痛肌紧张，腰大肌试验阳性，血白细胞升高，应诊断为
A. 右侧附件炎
B. 肠系膜淋巴结炎
C. 急性肠梗阻
D. 急性阑尾炎
E. 慢性阑尾炎

正确答案：D。急性阑尾炎

解析：患者转移性右下腹疼痛3天，右下腹压痛反跳痛肌紧张，腰大肌试验阳性，血白细胞升高，应诊断为急性阑尾炎，是由于梗阻和感染等因素造成（D对）。右侧附件炎其有下腹部疼痛，白带异常增多，部分有全身症状出现（A错）。肠系膜淋巴结炎有腹痛、发热、恶心、呕吐，腹泻或便秘。病变常累及回肠末端的一组淋巴结，故腹痛发生于脐周或右下腹，并有固定压痛点，无反跳痛及腹肌紧张（B错）。急性肠梗典型临床表现可以概括为痛、吐、胀和闭（C错）。慢性阑尾炎右下腹部疼痛，其特点是间断性隐痛或胀痛，病人常有轻重不等的消化不良、食欲下降。病程较长者可出现消瘦、体重下降，压痛是惟一的体征（E错）。